8〜10天，量多、色淡、质稀，神疲肢倦，小腹空坠，舌淡，脉缓弱，诊为月经先期。其证候是
A. 气虚
B. 实热
C. 虚热
D. 肝郁血热
E. 阳盛血热

正确答案：A。气虚

解析：根据题目可知，患者脾气虚弱，统血无权，冲任不固，故月经提前而量多；气虚火衰，血失温煦，则经色淡，质清晰；脾虚中气不足，故神疲肢倦，气短懒言，小腹空坠；运化失职，纳少便溏，舌淡红，苔薄白，脉细弱均为脾气虚之征（A对）。周期提前，经量多，色深红或紫红，质黏稠，舌质红，脉数有力者为阳盛血热，亦属实热之征（BE错）。周期提前，经量少，色红，质稠，脉虚而数者为阴虚血热，即虚热（C错）。周期提前，经量或多或少，经色紫红，质稠，或有血块，胸胁少腹胀满，脉弦者为肝郁血热之征（D错）。